香豆素母核上的¹H-NMR特征有
A. H-3，H-6和H-8在较高场
B. H-4，H-5和H-7在较低场
C. H-3和H-4的偶合常数约为9Hz
D. H-3，H-6和H-7在较高场
E. H-4，H-5和H-8在较低场

正确答案：A、B、C。H-3，H-6和H-8在较高场；H-4，H-5和H-7在较低场；H-3和H-4的偶合常数约为9Hz

解析：本题考查的是香豆素的核磁共振谱。香豆素母核上的¹H-NMR特征有H-3，H-6和H-8在较高场（A对）、H-4，H-5和H-7在较低场（B对）、H-3和H-4的偶合常数约为9Hz（C对）。